膀胱三角的位置在
A. 尿道内口与膀胱底之间
B. 输尿管间襞与膀胱尖之间
C. 尿道内口与膀胱尖之间
D. 尿道内口与两输尿管口之间
E. 尿道内口周围的三角形区域

正确答案：D。尿道内口与两输尿管口之间

解析：膀胱三角位于左、右输尿管口和尿道内口之间（D对）。